应激时体内分泌增加最重要的激素是
A. 儿茶酚胺
B. 胰高血糖素
C. ACTH
D. 糖皮质激素
E. 胰岛素

正确答案：D。糖皮质激素

解析：糖皮质激素（D对）是应激时体内分泌增加最重要的激素。